痛经的治疗原则是
A. 调理冲任气血
B. 温经暖宫止痛
C. 益肾养肝止痛
D. 益气补血止痛
E. 理气化瘀止痛

正确答案：A。调理冲任气血

解析：痛经以实证居多，而虚证较少，亦有证情复杂，实中有虚，虚中有实，虚实兼夹者，需知常达变。因本病病位在子宫、冲任，变化在气血，故治疗以调理子宫、冲任气血为主（A对）。